不属于妊娠期高血压疾病的是
A. 妊娠期高血压
B. 子痫前期
C. 子痫
D. 癫痫
E. 慢性高血压并发子痫前期

正确答案：D。癫痫

解析：妊娠期高血压疾病分为A.妊娠期高血压B.子痫前期C.子痫D.慢性高血压并发子痫前期E.妊娠合并慢性高血压5种类型，其中子痫前期又分为轻度和重度两个程度。掌握“娠期高血压疾病”知识点。